某患者主诉左侧面部感觉麻痹，刺激左眼角膜而左眼眨眼反射消失，但刺激右眼角膜，左眼眨眼反射正常。此外，病人下颌前突时偏向左侧，身体对侧痛温觉丧失，以及粗意向震颤和倾向左侧跌倒。与三叉神经有关的体征除外
A. 下颌前突时下颌偏向左
B. 左半面部感觉麻痹
C. 下颌反射减弱
D. 左眼轮匝肌瘫痪
E. 左侧眨眼反射消失

正确答案：A。下颌前突时下颌偏向左

解析：一侧三叉神经损伤，会造成左半面部感觉麻痹（B对）、下颌反射减弱（C对）、左眼轮匝肌瘫痪（D对）、左侧眨眼反射消失（E对），而不会造成下颌前突时下颌偏向左（A错，为本题正确选项）。